患者，男，48岁。近日腹痛便秘，胁下偏痛，发热，手足厥逆，舌苔白腻，脉弦紧。治疗应首选
A. 大承气汤
B. 温脾汤
C. 麻子仁丸
D. 济川煎
E. 大黄附子汤

正确答案：E。大黄附子汤

解析：本题考查常见的病症的辩证、处方。患者近日腹痛便秘，胁下偏痛，发热，手足厥逆，舌苔白腻，脉弦紧。因寒邪与积滞互结与肠道所致。方用大黄附子汤，本方证为温下法的代表方，又是治疗冷积便秘实证的常用方。附子温里散寒，止腹胁疼痛；大黄泻下通便，荡涤积滞；细辛泻下，去性存用（E对）。大承气汤为治疗阳明腑实证的基础方，又是寒下法的代表方（A错）。温脾汤证因脾阳不足，阴寒内盛，寒积中阻所致。为治疗脾阳不足，寒积中阻的常用方（B错）。麻子仁丸证因胃肠燥热，脾津不足所致。为治疗胃肠燥热，脾津不足之“脾约”证的常用方（C错）。济川煎证因肾虚开合失司所致。为温润通便，治疗肾虚便秘的常用方（D错）。